毛细血管内增生性肾小球肾炎的肉眼变化主要呈现
A. 大白肾
B. 大红肾
C. 颗粒性固缩肾
D. 瘢痕肾
E. 多囊肾

正确答案：B。大红肾